注射青霉素同时口服丙磺舒的相互作用属于
A. 物理学变化
B. 化学变化
C. 药效学变化
D. 药动学变化
E. 微生物学变化

正确答案：D。药动学变化